乳牙龋拔补牙数（deft）“拔”指
A. 因重度龋坏，临床无法治疗已拔除的乳牙
B. 因重度龋坏，临床无法治疗需要拔除的乳牙
C. 9岁以下儿童拔除了不该脱落的乳牙
D. 9岁以下儿童拔除了乳磨牙
E. 9岁以下儿童拔除了乳磨牙或乳尖牙

正确答案：A。因重度龋坏，临床无法治疗已拔除的乳牙

解析：指乳牙的龋、失、补牙数（dmft）或龋、失、补牙面数（dmfs），龋、失、补定义与恒牙龋相同，世界卫生组织计算失牙的标准是：9岁以下的儿童，丧失了不该脱落的乳牙，如：乳磨牙或乳尖牙，即为龋失。或用龋拔补牙数（deft）或龋拔补牙面数（defs）作为乳牙龋指数。“拔”指因重度龋坏，临床无法治疗已拔除的乳牙。也可用龋补牙数（dft）或龋补牙面数（dfs）说明人群中乳牙的患龋情况。掌握“龋病流行病学”知识点。